牙科X线片中，阻射X线最强的组织是
A. 牙髓
B. 牙骨质
C. 牙本质
D. 牙釉质
E. 牙槽骨

正确答案：D。牙釉质

解析：本题考查X线平片检查。牙科X线片中，阻射X线最强的组织是牙釉质（D对）。阻射和密度相关。密度越大，阻射越强。牙釉质为人体最致密的组织，所以牙釉质对X线的阻射性最强。牙由四种组织构成，即牙釉质、牙本质、牙骨质及牙髓。牙周组织包括牙周膜、牙槽骨和牙龈。①牙釉质：为人体中钙化程度最高的组织，X线片上影像密度亦最高，似帽状被覆在冠部牙本质表面。其在后牙面及前牙切缘最厚，由面和切缘向侧方至牙颈部逐渐变薄，终止于牙颈部。有时牙颈部近中或远中因投照技术问题造成低密度影像，位于牙釉质和牙槽嵴顶之间，称为牙颈部Burnout征象，为正常表现，勿与根面龋混淆。②牙本质（C错）：矿物质含量较牙釉质少，围绕牙髓构成牙齿主体，X线影像密度较牙釉质稍低。③牙骨质（B错）：覆盖于牙根表面牙本质上，很薄，在X线片上显示影像与牙本质不易区别。④牙髓腔（A错）：在X线片上显示为密度低影像。下颌磨牙牙髓腔似H形，上颌磨牙牙髓腔呈圆形或卵圆形。年轻人牙髓腔宽大，老年人髓室较年轻人小，根管亦细，这是随年龄增长有继发性牙本质形成所致。⑤牙槽骨（E错）：在X线片上显示的影像比牙密度稍低。上牙槽骨密质薄骨松质多，骨小梁呈交织状，X线片显示为颗粒状影像。下牙槽骨密质厚而骨松质少，骨小梁呈网状结构，牙间骨小梁多呈水平方向排列，而根尖部有时见放射状排列，骨髓腔呈三角形和大小不等的圆形低密度影像。牙槽骨的正常高度应达到牙颈部。⑥骨硬板：即固有牙槽骨，为牙槽窝的内壁，围绕牙根，X线片上显示为包绕牙根的、连续不断的高密度线条状影像。⑦牙周膜：X线片上显示为包绕牙根的连续不断的低密度线条状影像，厚度约为0.15～0.38mm，其宽度均匀一致。